正确叙述黄韧带的是
A. 连接相邻的椎弓根之间
B. 连接相邻的椎弓板之间
C. 连接相邻的横突之间
D. 参与椎管前壁的构成
E. 可限制脊柱过度后伸

正确答案：B。连接相邻的椎弓板之间

解析：黄韧带连结相邻两椎弓板之间（B对AC错），参与构成椎管后壁（D错），有限制脊柱过度前屈（E错）的作用。